男，32岁。腹泻3个月。大便每天7~10次，稀便，无脓血黏液，伴乏力，体重减轻5kg。患者7年前曾到东南亚某国打工3年。查体：慢性病容，肛门周围有疱疹，疱疹内容物镜检查偶见白细胞。最可能的诊断是
A. 艾滋病
B. 慢性菌痢
C. 渍疡性结肠炎
D. 慢性肠炎
E. 结肠癌

正确答案：A。艾滋病

解析：男，32岁。腹泻3个月。大便每日7〜10次，稀便，无脓血粘液，伴乏力，体重减轻5kg（符合艾滋病的临床症状）。患者7年前曾到东南亚某国打工3年（符合艾滋病的传染病接触史）。查体：慢性病容，肛门周围有疱疹，疱疹内容物镜检查偶见白细胞（符合艾滋病的临床体征表现及相关实验室化验结果表现）。综合以上临床表现和传染病接触史，该患者最可能的诊断是艾滋病（A对）。慢性菌痢（B错）为急性菌痢反复发作或迁延不愈达2个月以上者，急性菌痢常有畏寒、发热、腹泻等症状，长期腹泻可导致营养不良、贫血、乏力等。溃疡性结肠炎（C错）表现为反复发作的腹泻、黏液脓血便及腹痛，可有腹胀、食欲不振、恶心、呕吐等。慢性肠炎（D错）可表现各种肠道炎症性疾病，如慢性溃疡性结肠炎等，多表现为发热、腹痛、腹泻、肠梗阻等症状。结肠癌（E错）多见于中老年人，最早出现的症状为排便习惯改变，血便为最突出表现，多有腹痛和腹部肿块。